碘是人体必需微量元素，在无外来含碘的食物下，水碘含量可用于衡量当地居民摄碘量，当饮水碘含量低于多少时，可有碘缺乏病的流行
A. 1μg/L
B. 5μg/L
C. 10μg/L
D. 20μg/L
E. 50μg/L

正确答案：C。10μg/L

解析：本题考查碘摄入量。碘缺乏病是指从胚胎发育至成人期由于碘摄入量不足而引起的一系列病症。根据代谢测定，碘的生理需要量成人为100～300μg/d，我国推荐每日碘供给量150μg。碘主要来源于食物和水，在无外来含碘的食物下，水碘含量可用于衡量当地居民摄碘量，当饮水碘含量低于10μg/L（C对ABDE错）时，可有碘缺乏病的流行。